关于药物通过生物膜转运的错误表述是
A. 大多数药物通过被动扩散方式透过生物膜
B. 一些生命必需物质（如K⁺、Na⁺等），通过被动转运方式透过生物膜
C. 主动转运可被代谢抑制剂所抑制
D. 促进扩散的转运速度大大超过被动扩散
E. 主动转运药物的吸收速度可以用米氏方程式描述

正确答案：B。一些生命必需物质（如K⁺、Na⁺等），通过被动转运方式透过生物膜

解析：本题考查药物的转运方式。一些生命必需物质如K⁺，Na⁺，K⁺，单糖，氨基酸，水溶性维生素和有机酸、碱等弱电解质的离子型化合物等，能通过主动转运吸收（B错，为本题正确答案）；大多数药物通过被动扩散方式透过生物膜（A对）；主动转运受抑制剂的影响，能够被代谢抑制剂抑制（C对）；促进扩散顺浓度梯度转运，且有载体转运，速度快于被动扩散（D对）；主动转运药物的吸收速度可以用米氏方程式描述（E对）。